外科辨肿，肿势平坦，根盘散漫，其成因是
A. 火
B. 风
C. 气
D. 郁结
E. 虚

正确答案：E。虚

解析：外科中多种病因引起的经络阻隔、气血凝滞都可导致肿，因于火者，发病迅速，来势猛急，焮红灼热，肿势皮薄光泽，疼痛剧烈（A错）。因于风者，其肿宣浮，患部皮色或红或不变，痛无定处，走注甚速（B错）。因于气者，皮紧内软，按之凹陷，复手即起，不红不热，可随喜怒消长（C错）。因于郁结者，大小不一，可相互融合成片（D错）。因虚者，肿势平坦，根盘散漫，正虚不能托毒外出（E对）。